“乙癸同源”应归属于
A. 肝与心的关系
B. 肝与肾的关系
C. 肺与脾的关系
D. 肾与脾的关系
E. 肝与肺的关系

正确答案：B。肝与肾的关系

解析：以天干配五行，肝属乙木，肾属癸水，“乙癸同源”即“肝肾同源”（B对）。心与肝的关系，主要表现在行血与藏血以及精神情志调节两个方面（A错）；肺与脾的关系，主要表现在气的生成与津液代谢两个方面（C错）；脾与肾的关系，主要表现在先天后天相互资生与津液代谢方面（D错）；肺与肝的关系，主要体现在人体气机升降的调节方面（E错）；